在治疗肺炎球菌肺炎使用青霉素时，错误的方法是
A. 一般患者每次肌注80万单位，每8小时1次
B. 每日剂量800万单位，加在500ml输液中缓慢静滴
C. 每日剂量800万单位，分3次静脉滴注
D. 静脉滴药时每次用量应在1小时内滴完
E. 对青霉素过敏者不可使用此药

正确答案：B。每日剂量800万单位，加在500ml输液中缓慢静滴

解析：对于肺炎链球菌的治疗，首选青霉素，用药途径及剂量视病情轻重及有无并发症而定。对于成年轻症患者，可用240万U/d，分3次肌肉注射（A对），病情稍重者，用240万～480万U/d，分次静脉注射，每6～8小时一次，重症及并发脑膜炎者，可增至1000万～3000万U/d，分4次静脉滴注（C对）。青霉素的使用原则就是现配现用，分次配制，分次输入。每日剂量800万单位，加在500ml输液中缓慢静滴（B错，为本题正确答案），导致静滴的时间过长，使药物浓度降低，而且增加了青霉素水解和发生过敏反应的机会。